一位病人患左眼内斜视、左侧面部表情肌瘫痪、左耳听觉过敏，左侧舌前2／3味觉丧失。此外，左眼眨眼反射消失和左眼少泪，并伴有右半身上运动神经元瘫痪。下列什么脑神经麻痹会引起内斜视
A. 视神经
B. 动眼神经
C. 滑车神经
D. 三叉神经
E. 展神经

正确答案：E。展神经

解析：展神经（E对）损伤可引起外直肌瘫痪，产生内斜视。面神经管内损伤可出现听觉过敏、舌前 2/3 味觉障碍、泪腺和唾液腺的分泌障碍等症状。病人患左眼内斜视、左侧面部表情肌瘫痪、左耳听觉过敏，左侧舌前2／3味觉丧失，是面神经和展神经的麻痹。